作为上身肥胖的标准，我国提出的腰围标准为
A. 男性≥75cm，女性≥70cm
B. 男性≥80cm，女性≥70cm
C. 男性≥85cm，女性≥75cm
D. 男性≥85cm，女性≥80cm
E. 男性≥90cm，女性≥80cm

正确答案：D。男性≥85cm，女性≥80cm